患者，男，21岁，因过敏性鼻炎就诊。关于过敏性鼻炎药物治疗及用药教育的说法，错误的是
A. 过敏性鼻炎患者应尽量避免接触已知的过敏原
B. 治疗过敏性鼻炎使用口服糖皮质激素，首选地塞米松
C. 过敏性鼻炎的典型症状和感冒症状相似，应注意鉴别
D. 治疗过敏性鼻炎可局部使用糖皮质激素鼻喷剂
E. 季节性过敏性鼻炎患者应提前2～3周用药，季节过后继续用药2周

正确答案：B。治疗过敏性鼻炎使用口服糖皮质激素，首选地塞米松

解析：本题考查敏性鼻炎的药物治疗及用药教育。关于过敏性鼻炎药物治疗及用药教育的说法，错误的是治疗过敏性鼻炎使用口服糖皮质激素，首选地塞米松（B错，为本题正确答案）。过敏性鼻炎患者应尽量避免接触已知的变应原（A对），如宠物、羽毛、花粉等；做好室内环境控制，如经常通风、被褥衣物保持干燥，不使用地毯等。必要时口服糖皮质激素，首选泼尼松一次5mg，一日3次，激素的使用要在专科医生的指导下，切不可长期使用。过敏性鼻炎的典型症状和感冒症状相似，患者要注意区别（C对），如果没有办法确定，千万不可乱用药，要及时到医院确诊并进行合理的治疗。过敏性鼻炎可局部喷鼻，可选丙酸倍氯米松鼻喷雾剂，或选用布地奈德鼻喷雾剂（D对）。对季节性过敏性鼻炎应提前2～3周用药，季节过后，不能立即停药，应继续用药2周左右（E对）。